肺炎链球菌除主要导致大叶性肺炎外，还可导致
A. 支气管炎
B. 肺气肿
C. 大叶性肺炎
D. 小叶性肺炎
E. 支气管哮喘

正确答案：A。支气管炎

解析：肺炎链球菌所致疾病：主要为大叶性肺炎，其次为支气管炎和化脓性脑膜炎等。掌握“链球菌属”知识点。